下列对眼球的描述，错误的是
A. 虹膜是中膜最前面的部分
B. 前房角是由虹膜和角膜相交处构成,整体呈环状
C. 中膜又称脉络膜
D. 睫状体是中膜最肥厚的部分
E. 中央凹是视力最敏锐的地方

正确答案：C。中膜又称脉络膜

解析：眼球壁从外向内依次分为眼球纤维膜、血管膜和视网膜3层，故中膜是血管膜，而非脉络膜（C错，为本题正确答案）。中膜由前至后又可分为虹膜、睫状体和脉络膜3部分，故虹膜是中膜最前面的部分（A对）。睫状体是中膜最肥厚的部分（D对）。黄斑中央凹密布视锥细胞，且无血管走行，故是视力最敏锐的地方（E对）。前房角是由虹膜和角膜相交处构成，整体呈环状（B对）。